长期大量应用糖皮质激素可引起
A. 骨质疏松
B. 红细胞减少
C. 血小板减少
D. 高血钾
E. 血红蛋白减少

正确答案：A。骨质疏松

解析：本题考查长期使用糖皮质激素的不良反应。长期大量应用糖皮质激素可引起骨质疏松（A对）。糖皮质激素长期大量应用可引起医源性肾上腺皮质功能亢进综合征，系过量用药导致肪代谢和水盐代谢紊乱的结果。表现为肌无力与肌萎缩、皮肤变薄、向心性肥胖、满月脸、水牛背、痤疮、多毛、水肿、高血压、高脂血症、低钾血症（D错）、糖尿、骨质疏松等，停药后一般可自行恢复正常。糖皮质激素使红细胞和血红蛋白含量增加（BE错），大剂量可使血小板增多（C错）并提高纤维蛋白原浓度，缩短凝血时间。此外，可使血液中嗜酸细胞及淋巴细胞减少。